心室肌细胞动作电位的主要特征是
A. 0期除极迅速
B. 1期复极化快
C. 有缓慢的2期平台
D. 有快速的3期复极化
E. 有4期自动除极

正确答案：C。有缓慢的2期平台